颈内动脉的描述正确的是
A. 是脑、眶内结构和额鼻部血供的主要动脉
B. 分为上颌动脉与颞前动脉两终支
C. 颞浅动脉为颈内静脉的终末支
D. 穿腮腺实质或深面
E. 是颈前部、口腔颌面部、颅顶及硬脑膜等处的动脉主干

正确答案：A。是脑、眶内结构和额鼻部血供的主要动脉

解析：颈内动脉是脑、眶内结构和额鼻部血供的主要动脉，在颈动脉三角内起自颈总动脉，沿咽侧壁上行达颅底，经颞骨的颈动脉管进入颅内。掌握“颈内外动脉主要分支及分布”知识点。